∑y²=244464.11，则有
A. ｒ＝-1.84
B. ｒ＝1.84
C. r=0.84
D. 决定系数等于-0.71
E. 决定系数等于3.3856

正确答案：C。r=0.84